《突发公共事件应急条例》规定：突发事件应急工作应当遵循的原则是
A. 完善并建立监测与预警手段
B. 预防为主，常备不懈
C. 积极预防，认真报告
D. 及时调查，认真处理
E. 监测分析，综合评价

正确答案：B。预防为主，常备不懈

解析：《突发公共卫生事件应急条例》规定:突发事件应急工作应当遵循的原则是预防为主、常备不懈（B对），即提高全社会对突发公共卫生事件的防范意识，落实各项防范措施，做好人员、技术、物资和设备的应急储备工作。